腮腺导管的开口，平对上颌
A. 第2磨牙牙冠颊黏膜面上
B. 第1前磨牙牙冠相对应的颊粘膜处
C. 第1磨牙牙冠相对应的颊粘膜处
D. 第2前磨牙牙冠相对应的颊粘膜处
E. 第3磨牙牙冠相对应的颊粘膜处

正确答案：A。第2磨牙牙冠颊黏膜面上

解析：腮腺导管开口平对上颌第2磨牙牙冠的颊粘膜(A对)的腮腺管乳头上。